关于大黄化学成分的说法，正确的是
A. 主要含醌类化合物
B. 大黄酸是其质量控制成分之一
C. 主要含生物碱类化合物
D. 大多具有碱性
E. 大多具有酸性

正确答案：A、B、E。主要含醌类化合物；大黄酸是其质量控制成分之一；大多具有酸性

解析：本题考查的是大黄的化学成分。关于大黄化学成分的说法，正确的是主要含醌类化合物（A对）、大黄酸是其质量控制成分之一（B对）与大多具有酸性（E对）。从大黄中分离得到蒽醌、二蒽酮、芪、苯丁酮、单宁、萘色酮等不同种类的80多种化合物，大体上可分为蒽醌类、多糖类与鞣质类（C错）。其中蒽醌类及其衍生物含量为3%～5%，分为游离型与结合型。《中国药典》以总蒽醌和游离蒽醌为指标成分，采用高效液相色谱法测定药材和饮片中芦荟大黄素、大黄酸、大黄素、大黄酚和大黄素甲醚等总蒽醌的含量，要求药材总蒽醌不得少于1.5%，游离蒽醌不得少于0.20%。大黄含蒽醌类化合物，蒽醌类衍生物多具酚羟基，故具有酸性（D错）。